维持胸膜腔内负压的必要条件是
A. 呼吸道存在阻力
B. 胸膜腔密闭
C. 胸膜腔内有少量浆液
D. 肺内压低于大气压
E. 吸气肌收缩

正确答案：B。胸膜腔密闭